臀大肌止点位于髂胫束和
A. 股骨臀肌粗隆
B. 股骨小转子
C. 股骨内侧髁
D. 股骨髁间窝
E. 无

正确答案：A。股骨臀肌粗隆

解析：臀大肌止点位于髂胫束和股骨臀肌粗隆（A对）。